以下何种情况不属于拔牙适应证
A. 恶性肿瘤放射治疗前口内的残根
B. 腭侧错位牙，食物嵌塞，形成深龋
C. 滞留乳牙，无松动，恒牙先天缺失
D. 下磨牙远中、（牙合）面、颊面大面积龋坏达龈下2mm
E. 上前牙冠折1/3合并根折

正确答案：C。滞留乳牙，无松动，恒牙先天缺失

解析：本题考查拔牙的适应证。滞留乳牙，无松动，恒牙先天缺失（C错，为本题的正确答案）不属于拔牙适应证。滞留乳牙，无松动，恒牙先天缺失，可暂保留不予拔除，保留滞留乳牙可适当恢复咀嚼功能，利于美观、发音。恶性肿瘤放射治疗前口内的残根属于拔牙适应证（A对），放射治疗不可避免的会对正常组织产生损伤，引起放射性骨坏死，若此残根继发感染，会导致放射性骨髓炎，故残根应拔除。腭侧错位牙，食物嵌塞，形成深龋属于拔牙适应证（B对），治疗不便且不能通过正畸恢复正常位置，故应拔除。下磨牙远中、（牙合）面、颊面大面积龋坏达龈下2mm属于拔牙适应证（D对），缺损面积过大，现有修复手段难以恢复和利用，故应拔除。上前牙冠折1/3合并根折属于拔牙适应证（E对），冠根联合折，骨折线与口腔相通，即便可以进根管治疗，剩余牙体组织过少也无法用现有手段恢复和利用，故应拔除。